保证血液安全的前提和基础是
A. 无偿献血
B. 血液检测
C. 成分输血
D. 自身输血
E. 避免不必要的输血

正确答案：A。无偿献血

解析：一些全球性的调查数据显示，自愿无偿献血者的血液传播艾滋病病毒和肝炎病毒的几率是最低的，而且，自愿无偿献血者作为固定的血液捐献者，可以使临床用血获得安全、稳定的血液来源，并且传播艾滋病病毒和肝炎病毒的几率几乎是最低的。因此无偿献血（A对）无疑是保证血液安全的基础和保障。